易逆性抗胆碱酯酶药的作用机制为
A. 与AChE形成二甲胺基甲酰化复合物
B. 生成更为稳定的单烷氧基磷酰化AChE
C. 与AChE形成磷酰化复合物
D. 药物可引起AChE明显“老化”
E. 形成的磷酰化复合物不能自行水解

正确答案：A。与AChE形成二甲胺基甲酰化复合物

解析：易逆性抗胆碱酯酶药的作用机制为与AChE形成二甲胺基甲酰化复合物（A对）。有机磷酸酯类类进入人体后，其亲电子性的磷原子与AChE酯解部位丝氨酸轻基上具有亲核性的氧原子以共价键结合，形成难以水解的磷酰化AChE（CE错），使AChE失去水解ACh的能力，造成ACh在体内大量积聚，引起一系列中毒症状。若不及时抢救，AChE可在几分钟或几小时内“老化”（D错）。“老化“过程可能是磷酸化AChE的磷酰化基团上的一个烷氧基断裂，生成更为稳定的单烷氧基磷酰化AChE（B错）（P61）。